应用激素替代疗法治疗围绝经期综合征的适应症是
A. 可疑乳腺癌
B. 可疑宫内膜癌
C. 因孕激素水平低落而产生明显的神经血管舒缩性
D. 因雌激素水平低落而产生明显的神经血管舒缩性
E. 心血管疾病或凝血功能亢进者

正确答案：D。因雌激素水平低落而产生明显的神经血管舒缩性

解析：性激素补充疗法（HRT）是以雌激素为主，辅以孕激素治疗，因雌激素水平低落而产生明显的神经血管舒缩性（D对C错）。激素治疗的禁忌证包括已知或怀疑妊娠、乳腺癌及性激素相关的恶性肿瘤（A错）、原因不明的子宫内膜增生（B错）。慎用情况包括有血栓或血栓倾向的疾病，心血管疾病或凝血功能亢进者可导致血栓产生或有此倾向，故排除（E错）。